男，60岁。近3天夜间行为紊乱，说房间地板上有老鼠、蛇，能看见死人，表情恐怖、紧张，不认识家人，白天较安静，喜卧床，不能回忆夜间行为，能认识家人，头部CT示：顶枕叶片状梗死灶，考虑患者处于
A. 痴呆状态
B. 幻觉妄想状态
C. 抑郁状态
D. 谵妄状态
E. 木僵状态

正确答案：D。谵妄状态

解析：该患者近3天夜间能看见老鼠、蛇、死人（幻视、错觉），表情恐怖、紧张（情绪紊乱），不认识家人，白天安静，喜卧床，不能回忆夜间行为，能认识家人，患者以意识障碍为主要临床表现，表现为昼轻夜重，头部CT示：顶枕叶片状梗死灶，考虑为谵妄状态（D对）。痴呆以记忆力减退为主要特征，本例无此症状，故不考虑（A错）。抑郁发作以显著而持久的情感低落（忧愁、苦闷、唉声叹气、暗自落泪等）为主要表现，伴有兴趣缺乏、快感缺失等，本例无此症状，故不考虑（C错）。